用于肝细胞癌病人普查诊断判断疗效和预测复发的检验项目应首选
A. 甲胎蛋白
B. γ-谷氨酰转肽酶
C. 异常凝血酶原
D. α-L岩藻糖苷酶
E. 碱性磷酸酶

正确答案：A。甲胎蛋白

解析：甲胎蛋白是在胎儿早期由肝脏和卵黄囊合成的一种血清糖蛋白，出生后，AFP的合成很快受到抑制。当肝细胞或生殖腺胚胎组织发生恶性病变、妊娠时，有关基因重新被激活，使原来丧失合成AFP能力的细胞又重新开始合成，以致血中AFP含量明显升高。在排除妊娠和生殖腺胚胎瘤的基础上，甲胎蛋白（A对）可用于诊断肝细胞癌，阳性率约为70%，现已广泛用于肝癌的普查、诊断、判断治疗效果及预测复发。γ-谷氨酰转肽酶（B错）、异常凝血酶原（C错）、α-L岩藻糖苷酶（D错）、碱性磷酸酶（E错）都有助于肝细胞癌的诊断，尤其是在AFP阴性的肝癌患者，但是特异性不高。